下列各项，与妊娠剧吐有关的激素是
A. 雌激素
B. 孕激素
C. 绒毛膜促性腺激素
D. 促黄体生成素
E. 催乳素

正确答案：C。绒毛膜促性腺激素

解析：妊娠剧吐确切病因不明，可能与孕妇血中β-HCG（绒毛膜促性腺激素）水平急剧升高有关（C对）。雌激素促进子宫内膜增生及修复（A错）孕激素则限制子宫内膜增生，并使增生期内膜转化为分泌期（B错）。促黄体生成素可促进胆固醇在性腺细胞内转化为性激素（D错）。催乳素主要作用为促进乳腺发育生长，刺激并维持泌乳，还有刺激卵泡LH受体生成等作用（E错）。